Palmer记录中乳牙以英语字母表示，其中A代表
A. 乳中切牙
B. 乳侧切牙
C. 乳尖牙
D. 第一乳磨牙
E. 第二乳磨牙

正确答案：A。乳中切牙

解析：Palmer记录系统也是分为上、下、左、右四区，恒牙记录同部位记录法；乳牙以英语字母A～E代表每区的乳中切牙至第二乳磨牙。掌握“牙的组成、分类、功能及牙位记录”知识点。